老年人因脏腑生理功能衰退，常感体力不济，记忆力不如以前想服用滋补药增强体质，但需辨证选药，合理使用。心脾两虚者宜用
A. 六味地黄丸
B. 薯蓣丸
C. 龟龄集
D. 人参归脾丸
E. 生脉饮

正确答案：D。人参归脾丸

解析：本题考查的是老年人合理服用滋补药的注意事项。老年人因脏腑生理功能衰退，常感体力不济，记忆力不如以前想服用滋补药增强体质，但需辨证选药，合理使用。心脾两虚者宜用人参归脾丸（D对）。老年人合理服用滋补药的注意事项：老年人由于生理功能的衰退，常感到体力、精力不如往年，总想用些滋补药来增强体质，延年益寿。但在使用滋补药时，要严格遵照中医的辨证论治，按需行补，不需不补。如果不辨病证，不分气血、阴阳、寒热、温凉，滥用补药，很容易引起病情加重或诱发新的疾病。例如老年慢性支气管炎日久会出现肺阴虚之象，宜用西洋参、沙参等益气养阴清热，若用红参，偏于甘温，反而使余邪复燃，病情加重。所以老年人选用补药应弄清自己的体质情况，属于哪一种证型，再根据补药的药性，合理选用，达到补而不滞，滋而不腻。老年人的体虚，也有阴虚、阳虚、气虚、血虚和心、肝、脾、肺、肾等不同脏器虚衰之区别。阴虚者选用清补型滋补剂，如大补阴丸；偏于阳虚者应服用温补型滋补剂，如龟龄集（C错）；肾阴虚老人宜服用六味地黄丸（A错）；心脾两虚老人宜服人参归脾丸。除此之外，病体还有寒热虚实之别。所以，辨证应用补药，才能药到病除，补到虚消。中医讲究按季节时令使用滋补药，即“春暖平补”“夏暑清补”“秋燥润补”“冬寒大补”。四季比较，以秋冬为佳，尤以冬季最佳，此季人体的阴精阳气也趋于潜藏，补益阴精阳气易于吸收而藏于体内，使体质得到增强，起到扶正固本的作用。如果忽略季节时令，春夏大补，则易上火，出现口干、咽燥，甚至引发新的病证。由于滋补药的种类很多，服用方法和剂量以及用药注意事项可参照说明书，但剂量常标明一定的幅度，采用低限或高限量应按个人情况而定。药酒还应根据自己的酒量酌情服用，不会饮酒的，可从小剂量开始逐渐加大。薯蓣丸（B错）为虚劳血虚证的中成药应用。虚劳血虚证：【中成药应用】常用中成药有归芪口服液、再造生血片、薯蓣丸。生脉饮（E错）：【功能】益气复脉，养阴生津。【主治】气阴两亏，心悸气短，脉微自汗。